一臀位娩出婴儿，生后发现左大腿肿胀缩短畸形，并有异常活动。如经检查诊断为左股骨干骨折，其首选的治疗方法应该是
A. 切开复位内固定手术
B. 手法复位，小夹板外固定
C. 垂直悬吊牵引
D. 蛙位石膏外固定
E. 将伤肢用绷带固定于胸腹部

正确答案：E。将伤肢用绷带固定于胸腹部

解析：股骨干骨折（P663）的非手术治疗主要用于较稳定的股骨干骨折，成人可采用Braun架固定或Thomas架平衡持续牵引；儿童多采用手法复位、小夹板固定、皮肤牵引维持方法治疗（B错）；3岁以下幼儿为垂直悬吊皮肤牵引（C错）；新生儿产伤所致的股骨干骨折可将伤肢用绷带固定于胸腹部，2周后拆除（E对）。蛙位石膏外固定（D错）主要用于小儿股骨干骨折和发育性髋关节脱位的治疗。切开复位内固定手术（A错）主要用于手法复位失败、多处骨折、合并神经血管损伤的患者。